以同一批原料药在同一连续生产周期内生产的均质产品为一批的属于
A. 大容量注射剂
B. 粉针剂
C. 固体制剂
D. 液体制剂
E. 冻干粉针剂

正确答案：B。粉针剂